被狂犬咬伤后最正确的处理方式是
A. 注射狂犬病病毒免疫血清+抗病毒药物
B. 注射大量丙种球蛋白+抗病毒药物
C. 清创+抗生素
D. 清创+接种疫苗+注射狂犬病病毒免疫血清
E. 清创+注射狂犬病病毒免疫血清

正确答案：D。清创+接种疫苗+注射狂犬病病毒免疫血清

解析：若人被犬等动物咬伤后，应立即清洗消毒伤口，使用高效价抗狂犬病病毒血清行伤口周围浸润注射及肌内注射，并将该动物捕获隔离观察，若经5～7日不发病，则一般认为该动物不是传染源。掌握“狂犬病、人乳头瘤病毒”知识点。